40～50个/HP。首选的治疗药物是
A. 呋塞米
B. 毛花苷丙
C. 硝普钠
D. 低分子右旋糖酐
E. 糖皮质激素

正确答案：A。呋塞米

解析：本例患儿水肿、血尿、少尿，双肺底可闻及少量湿啰音，肝肋下2cm，尿蛋白阳性，尿中见红细胞、白细胞，诊断为急性肾小球肾炎严重循环充血，首选治疗应为利尿、消水肿、改善循环充血，首选的治疗药物是呋塞米（A对）。毛花苷丙（B错）为洋地黄药物，多用于快速房颤和收缩性心衰。硝普钠（C错）多用于高血压性心衰。低分子右旋糖酐（D错）多用于扩充血容量。糖皮质激素（E错）多用于抗炎、抗病毒、免疫治疗。